急性胃炎的临床表现是
A. 呕吐物为隔餐食物，带腐臭味
B. 呕吐物为黄绿色，带粪臭味
C. 呕吐物为大量粘液及食物
D. 呕吐物为血液
E. 吐出胃内容物后仍干呕不止

正确答案：C。呕吐物为大量粘液及食物

解析：急性胃炎呕吐物为大量粘液及食物（C对）。幽门梗阻呕吐物为隔餐食物，带腐臭味（A错）；低位小肠梗阻呕吐物为黄绿色，带粪臭味（B错）；食管或胃出血呕吐物为血液（D错）妊娠剧吐可出现吐出胃内容物后仍干呕不止（E错）。